对诊断原发性肝癌最有意义的是
A. AST
B. γ-GT
C. ALT
D. AFP
E. ALP

正确答案：D。AFP

解析：对诊断原发性肝癌最有意义的是AFP，甲胎蛋白与肝癌及多种肿瘤的发生发展密切相关，在多种肿瘤中均可表现出较高浓度，可作为多种肿瘤的阳性检测指标。目前临床上主要作为原发性肝癌的血清标志物，用于原发性肝癌的诊断及疗效监测（D对）。AST临床一般常作为心肌梗死和心肌炎的辅助检查（A错）。γ-GT即γ-谷氨酰转肽酶，临床上此酶测定主要用于诊断肝胆疾病，是胆道梗阻和肝炎活动的指标（B错）。ALT谷丙转氨酶是诊断病毒性肝炎、中毒性肝炎的重要指标（C错）。ALP碱性磷酸酶，临床上测定ALP主要用于骨骼、肝胆系统疾病的诊断和鉴别诊断，尤其是黄疸的鉴别诊断。对于不明原因的高ALP血清水平，可测定同工酶以协助明确其器官来源（E错）。